患者面浮肢肿，腹部胀满，咳嗽喘息，咯痰清稀，心悸，怕冷，纳差，尿少，便溏，舌胖苔白滑，脉沉细。其治法是
A. 温肾健脾，化饮利水
B. 温肾补肺，化痰利水
C. 温脾补肺，化瘀利水
D. 温肺补肾，化瘀利水
E. 补肺纳气，化瘀平喘

正确答案：A。温肾健脾，化饮利水

解析：根据“面浮肢肿，腹部胀满，咳嗽喘息，咯痰清稀，心悸”可知病为“肺胀”；根据“怕冷，纳差，尿少，便溏，舌胖苔白滑，脉沉细”可辨为“阳虚水泛证”，该证机理为肺病日久，脾虚不能转输，肾虚不能蒸化，痰浊胀留益甚，喘咳持续难已，久延阳虚阴盛，气不化津，痰从阴化为水饮。治宜温肾健脾，化饮利水（A对）。